男，65岁。因呼吸困难、下肢水肿2周就诊。既往COPD病史15年。该患者体格检查时最不可能的体征
A. P₂＞A₂
B. 桶状胸
C. 二尖瓣收缩期杂音
D. 颈静脉怒张
E. 三尖瓣收缩期杂音

正确答案：C。二尖瓣收缩期杂音

解析：患者COPD病史15年，视诊可见胸廓前后径增大，肋间隙增宽，剑突下胸骨下角增宽，称为桶状胸（B对）。2周前发生呼吸困难、下肢水肿等症状，并未出现肺性脑病体征，可以诊断为慢性肺源性心脏病心、肺功能代偿期。慢性肺心病代偿期的体征包括原发肺脏疾病体征，如肺气肿体征（B对），干、湿性啰音，P₂＞A₂（A对），三尖瓣区可出现收缩期杂音或剑突下心脏搏动增强（E对）等。部分患者因肺气肿使肺内压升高，阻碍腔静脉回流，可有颈静脉充盈甚至怒张（D对），或使横膈下降致肝界下移。慢性肺源性心脏病代偿期并没有累及左心室，所以不会出现二尖瓣收缩期杂音（C错，为本题正确答案）。